Ⅳ度根分叉区病变，最不需做哪项治疗
A. 牙龈切除术
B. 牙周翻瓣手术
C. 洁治术
D. 刮治术
E. 根面平整术

正确答案：A。牙龈切除术

解析：本题考查Ⅳ度根分叉区病变的治疗。Ⅳ度根分叉区病变，最不需做牙龈切除术（A错，为本题的正确答案）。牙龈切除术是用手术的方法切除增生肥大的牙龈或牙周袋，重建牙龈的生理外形及正常的龈沟。牙周病手术治疗前应经过牙周基础治疗进行洁治（C对），刮治（D对），牙根外形不利于菌斑控制者应进行根面平整术（E对）后才能进行手术治疗。牙周翻瓣后，能更好的暴露病变组织（B对）。在做截根术、分根术或牙半切术前，均应做完善的根管治疗，还应进行调（牙合），以减轻患牙的咬合负担。